下列临床表现与急性肾小球肾炎不符合的是
A. 链球菌感染后两周出现血尿蛋白尿
B. 病程中出现C3下降
C. 高血压持续2个月以上
D. 可并发心力衰竭
E. 部分患者要有ASO水平升高

正确答案：C。高血压持续2个月以上

解析：急性肾小球肾炎主要是由β-溶血性链球菌感染后所诱发的免疫反应引起，诱发免疫反应后可通过IgG及C3等循环免疫复合物沉积于肾小球致病，因此病程中可出现C3下降（B对），部分患者有ASO（血清抗链球菌溶血素O）水平升高（E对）。患者通常于链球菌感染后两周出现血尿、蛋白尿（A对），约80%患者可出现一过性轻、中度高血压（C错，为本题正确答案），常与水、钠潴留有关。严重的水、钠潴留和高血压可诱发充血性心力衰竭（D对）。